房间隔缺损是先天性心脏病的一种，下面描述不正确的是
A. 房间隔缺损轻者可无症状
B. 房间隔缺损是房间隔在胚胎发育过程中发育不良所致
C. 体检可见心前区隆起
D. 肺动脉瓣第2音分裂明显但不固定
E. 患儿易患肺炎

正确答案：D。肺动脉瓣第2音分裂明显但不固定